患者胸膈疼痛，食不得下而复吐，甚至水饮难下，大便坚如羊屎，面色晦滞，形体消痩。舌红少津，脉细涩。其治法是
A. 滋阴养血，破结行瘀
B. 益气养阴，行气化痰
C. 养阴润燥，降气消导
D. 润燥行瘀，开郁化痰
E. 滋阴养血，散结化痰

正确答案：A。滋阴养血，破结行瘀

解析：患者以“胸膈疼痛，食不得下而复吐，甚至水饮难下”为主症，故可诊断为噎嗝。瘀血内结，食道不利，故见胸膈疼痛，食不得下而复吐，甚至水饮难下；病久，阴血更伤，肠道失润，故见大便坚如羊屎；长期饮食不入，化源告竭，故见面色晦滞，形体消痩；舌红少津，脉细涩，均为瘀血内结之征，应滋阴养血，破结行瘀（A对）。益气养阴，行气化痰（B错）治疗气阴两虚证。养阴润燥，降气消导（C错）治疗阴虚气逆证。润燥行瘀，开郁化痰（D错）治疗阴虚痰凝证。滋阴养血，散结化痰（E错）治疗阴亏血少证。